男婴，10天。因发热拒奶3天，惊厥2次来诊。查体反应差，中度黄染，脐部有脓性分泌物，前囟饱满。WBC20×10⁹/L，N0.78，L0.22。最可能的病原体是
A. 流感嗜血杆菌
B. 新型隐球菌
C. 大肠埃希菌
D. 肺炎链球菌
E. 脑膜炎双球菌

正确答案：C。大肠埃希菌

解析：患儿，出生10天，因发热拒奶3天，惊厥2次来诊，提示出生7天发病（早发型7天内发病），怀疑感染，查体反应差（新生儿败血症一般临床表现），中度黄染（黄疸可为败血症唯一表现），脐部有脓性分泌物（提示感染），前囟饱满（提示颅内压升高）。WBC20×10⁹/L（正常值4～10×10⁹/L，提示存在感染），N0.78，L0.22。根据该患儿的临床表现、体查及实验室检查，最可能诊断为新生儿败血症早发型合并脑膜炎。早发型新生儿败血症常由母亲垂直传播引起，病原菌以大肠埃希菌（C对）等革兰阴性杆菌为主。